男性，50岁，左耳垂后下肿胀破溃后有脓液流出，其中可见针尖大小淡黑色颗粒，经化验为硫磺颗粒。对于该病最有效的药物是
A. 大环内酯类
B. 青霉素族
C. 喹诺酮类
D. 氨基糖苷类
E. 硝基咪唑类抗生素

正确答案：B。青霉素族

解析：本题考查放线菌病的防治原则。男性，50岁，左耳垂后下肿胀破溃后有脓液流出，其中可见针尖大小淡黑色颗粒，经化验为硫磺颗粒，应考虑诊断为放线菌病。对于该病最有效的药物是青霉素族（B对）。大环内酯类（A错）抗菌谱较窄，主要对大多数G+菌、厌氧球菌和包括奈瑟菌、嗜血杆菌及白喉棒状杆菌在内的部分G-菌有强大抗菌活性，对嗜肺军团菌、弯曲菌、支原体、衣原体、弓形虫非典型分枝杆菌等也具有良好作用；对产生β-内酰胺酶的葡萄球菌和耐甲氧西林金黄色葡萄球菌（MRSA）有一定抗菌活性。喹诺酮类（C错）属广谱杀菌药，对革兰阴性菌的良好抗菌活性，对革兰阳性菌、结核分枝杆菌、军团菌、支原体及衣原体的有杀灭作用，对厌氧菌如脆弱类杆菌、梭杆菌属、消化链球菌属和厌氧芽孢梭菌属等的抗菌活性。 氨基糖苷类（D错）对各种需氧G-杆菌包括大肠埃希菌、铜绿假单胞菌、变形杆菌属、克雷伯菌属、肠杆菌属、志贺菌属和枸橼酸杆菌属具有强大抗菌活性；对沙雷菌属、沙门菌属、产碱杆菌属、不动杆菌属和嗜血杆菌属也有一定抗菌作用；对淋病奈瑟菌、脑膜炎奈瑟菌等G-球菌作用较差；对MRSA和MRSE也有较好抗菌活性，对各组链球菌作用微弱，对肠球菌和厌氧菌不敏感。硝基咪唑类抗生素（E错）主要用于对各种厌氧菌，对滴虫、阿米巴也有效。